注入右淋巴导管
A. 右侧上半身
B. 右侧下半身
C. 右支气管纵隔干
D. 锁骨上淋巴结
E. 右腰干

正确答案：C。右支气管纵隔干

解析：右淋巴导管由右颈干、右锁骨下干和右支气管纵隔干（C对）组成。